医德评价应坚持依据的辩证统一是指
A. 动机与目的、效果与手段的统一
B. 动机与效果、目的与手段的统一
C. 动机与手段、目的与效果的统一
D. 目的与效果、目的与手段的统一
E. 目的与动机、动机与效果的统一

正确答案：B。动机与效果、目的与手段的统一